某医生受行政处罚，于2018年9月吊销医师执业证书，按规定，可重新注册的时间是
A. 2020年9月
B. 2021年9月
C. 2020年3月
D. 2019年9月
E. 2019年3月

正确答案：A。2020年9月

解析：本题考查执业医师的注册。某医生受行政处罚 ，于2018年9月吊销医师执业证书 ，按规定 ，可重新注册的时间是2020年9月（A对）。根据不予注册执业医师证书的条件可知，吊销医师执业证书后满两年可以申请重新注册。